21世纪人人享有卫生保健的总目标中不包括
A. 提高平均期望寿命
B. 提高生活质量
C. 卫生系统的可持续发展
D. 提供免费服务
E. 改善国家内部和国际间健康公平性

正确答案：D。提供免费服务